中央性颌骨癌最主要的治疗方法是
A. 手术治疗
B. 放射治疗
C. 化学治疗
D. 冷冻治疗
E. 免疫治疗

正确答案：A。手术治疗

解析：手术是治疗中央性颌骨癌的主要方法。根据中央性颌骨癌的病变扩散特点，下颌骨的切除范围应更加广泛。限于一侧者一般应行半侧下颌骨切除；如邻近中线或超越中线者，应根据解剖特点于对侧下颌骨颏孔或下颌孔处截骨；或甚至行全下颌骨切除。中央性颌骨癌一般应行选择性颈淋巴清扫术。为了防止远处转移，尚应配合化疗。掌握“中央性颌骨癌及上颌窦癌”知识点。